连舌本，散舌下的经脉是
A. 足厥阴肝经
B. 足少阴肾经
C. 足太阴脾经
D. 足阳明胃经
E. 足少阳胆经

正确答案：C。足太阴脾经

解析：经脉循行夹咽，连舌本，散舌下的是足太阴脾经（C对）。足厥阴肝经的经脉循行属肝，络胆，夹胃，注肺，过阴器，连目系，环唇内（A错）。足少阴肾经的循行属肾，络膀胱，上贯肝，入肺中，络心，循喉咙，夹舌本（B错）。足阳明胃经属胃，络脾，其循行起于鼻，入上齿，环口夹唇，循喉咙（D错）。足少阳胆经属胆，络肝，其循行起于目锐眺，下耳后，入耳中，出耳前（E错）。